可减少或避免肝脏首过效应的给药途径或剂型是
A. 舌下片给药
B. 口服胶囊
C. 栓剂
D. 静脉注射
E. 透皮吸收给药

正确答案：A、C、D、E。舌下片给药；栓剂；静脉注射；透皮吸收给药

解析：本题考查栓剂。舌下片（A对）经舌下黏膜吸收，可避免肝脏对药物的首过效应；栓剂（C对）经肛门给药，大部分药物不经过肝脏；静脉注射药物（D对）直接进入血液循环，不经过肝脏，无首过效应；透皮吸收给药（E对）是指药物以一定的速率透过皮肤经毛细血管吸收进入体循环，可避免肝脏的首过效应和胃肠道因素的干扰；口服胶囊（B错）经过胃肠道吸收，不能避免首过效应。